阑尾切除术最常见的并发症是
A. 出血
B. 粪瘘
C. 腹腔脓肿
D. 切口感染
E. 粘连性肠梗阻

正确答案：D。切口感染

解析：阑尾切除术后并发症有出血、切口感染、粘连性肠梗阻、阑尾残株炎、粪瘘等，其中切口感染是最常见的术后并发症（D对），多见于急性化脓性或穿孔性阑尾炎。